嗜铬细胞瘤下列临床表现中，最具特征性的应为
A. 阵发性高血压或持续性高血压阵发性加剧
B. 发作性头痛
C. 胸闷、多汗、心动过速
D. 恶心、呕吐、腹痛
E. 焦虑、神经过敏

正确答案：A。阵发性高血压或持续性高血压阵发性加剧